易受环境因素损害的部分人群称为
A. 亚健康人群
B. 非健康人群
C. 暴露人群
D. 敏感人群
E. 对照人群

正确答案：D。敏感人群

解析：本题考查敏感人群。易受环境因素损害的部分人群称为敏感人群（D对ABCE错）。敏感人群主要包括儿童、老年人、孕妇、患者、残疾人等，他们的身体和生理机能都相对较弱，对外界环境变化的反应也更加敏感，容易受到损害。